某医学院学生来到某农村社区，将自己视为该社区的成员，并通过细致的生活体验，获得了当地居民饮用水、粪便处理和肠道传染病发病情况的一手资料，这种现场调查的方法是
A. 定量调查
B. 回顾性调查
C. 前瞻性调查
D. 观察法
E. 深入访谈法

正确答案：D。观察法